治疗阴虚火旺，潮热盗汗、咳嗽咯血、耳鸣遗精的中成药是
A. 玉泉丸
B. 金锁固精丸
C. 大补阴丸
D. 河车大造丸
E. 五子衍宗丸

正确答案：C。大补阴丸

解析：本题考查的是大补阴丸的主治。治疗阴虚火旺，潮热盗汗、咳嗽咯血、耳鸣遗精的中成药是大补阴丸（C对）。大补阴丸：【主治】阴虚火旺，潮热盗汗，咳嗽咯血，耳鸣遗精。玉泉丸（A错）：【主治】阴虚内热所致的消渴，症见多饮、多食、多尿；2型糖尿病见上述证候者。金锁固精丸（B错）：【主治】肾虚不固所致的遗精滑泄、神疲乏力、四肢酸软、腰酸耳鸣。河车大造丸（D错）：【主治】肺肾两亏，虚劳咳嗽，骨蒸潮热，盗汗遗精，腰膝酸软。五子衍宗丸（E错）：【主治】肾虚精亏所致的阳痿不育、遗精早泄、腰痛、尿后余沥。